中线致死性肉芽肿的治疗应首选
A. 手术
B. 放疗
C. 化疗
D. 激素
E. 冷冻

正确答案：B。放疗

解析：本题考查的是中线致死性肉芽肿的治疗措施。口腔颌面部致命性中线肉芽肿对放射治疗（B对）敏感，故放疗应为治疗方法的首选，并同时激素治疗（以泼尼松为主），多发性病变应予化学药物及激素治疗。手术治疗（A错）是不可逆的破坏性治疗方法，肉芽肿很难彻底切除且易复发，不应首选手术。单纯的化疗（C错）效果并不理想。激素（D错）治疗的适应症为浅表病损，常作为辅助治疗手段存在。冷冻治疗（E错）可用于治疗口腔颌面部良性肿瘤，以及早期（最好限于T1）的以及复发局限的口腔颌面部恶性肿瘤，而中线致死性肉芽肿病变广泛多发，且对冷冻不敏感，故不宜选择冷冻治疗。